某铸造工人，接触粉尘作业30年，因咳嗽、气短胸闷、胸痛而到医院诊治，医师怀疑他患硅沉着病。诊断的依据应该是
A. 职业接触史、实验室检查和临床表现
B. 职业接触史和临床表现
C. 职业接触史、特异生化指标和临床表现
D. 胸部X线片、肺功能测定和临床表现
E. 胸部X线片、肺通气量测定和临床表现

正确答案：B。职业接触史和临床表现